铅及其化合物主要以下列哪种形式进入人体
A. 烟
B. 蒸汽
C. 雾
D. 粉尘、烟或蒸汽
E. 以上都不是

正确答案：D。粉尘、烟或蒸汽